属于萘醌类化合物的是
A. 汉黄芩素
B. 紫草素
C. 葛根素
D. 黄芩苷
E. 大黄素

正确答案：B。紫草素

解析：本题考查的是醌类化合物的分类。属于萘醌类化合物的是紫草素（B对）。紫草素为紫草的主要化学成分。紫草的主要化学成分为萘醌类化合物，包括乙酰紫草素、欧紫草素、紫草素、β，β'-二甲基丙烯酰紫草素、β，β'-二甲基丙烯酰欧紫草素、去氧紫根素等。《中国药典》采用紫外分光光度法测定药材中羟基萘醌总含量，以左旋紫草素计，不得少于0.80%，采用高效液相色谱法测定药材中β，β'-二甲基丙烯酰阿卡宁（β，β'-二甲基丙烯酰欧紫草素）的含量，不得少于0.30%。汉黄芩素（A错）与黄芩苷（D错）为黄芩的主要化学成分，属于黄酮类化合物。黄芩中主要成分及其化学结构：从黄芩中分离出来的黄酮类化合物有黄芩苷（含4.0%～5.2%）、黄芩素、汉黄芩苷、汉黄芩素等20种成分。其中黄芩苷是主要有效成分。《中国药典》以黄芩苷为指标成分进行含量测定要求药材含量不得少于9.0%，饮片含量不得少于8.0%。葛根素（C错）为葛根的主要化学成分，属于异黄酮类化合物。葛根含异黄酮类化合物，主要成分有大豆素、大豆苷、大豆素-7，4'-二葡萄糖苷及葛根素、葛根素-7-木糖苷。《中国药典》以葛根素为指标成分进行含量测定，要求含葛根素不得少于2.4%。大黄素（E错）为大黄的主要化学成分，属于蒽醌类化合物。从大黄中分离得到蒽醌、二蒽酮、芪、苯丁酮、单宁、萘色酮等不同种类的80多种化合物，大体上可分为蒽醌类、多糖类与鞣质类。其中蒽醌类及其衍生物含量为3%～5%，分为游离型与结合型。《中国药典》以总蒽醌和游离蒽醌为指标成分，采用高效液相色谱法测定药材和饮片中芦荟大黄素、大黄酸、大黄素、大黄酚和大黄素甲醚等总蒽醌的含量，要求药材总蒽醌不得少于1.5%，游离蒽醌不得少于0.20%。